早期急性病毒性肝炎患者的饮食应是
A. 高糖
B. 高蛋白
C. 高脂肪
D. 尽量多食
E. 清淡易消化

正确答案：E。清淡易消化

解析：早期急性病毒性肝炎患者饮食宜清淡易消化，适当补充维生素，热量不足者应静脉补充葡萄糖（E对）。三高一低，高蛋白（B错）、高糖（A错）、高维生素和低脂肪（C错）饮食营养是病毒性肝炎基础治疗的重要内容，也是促进康复的重要措施之一。